目前我国血压偏高的儿童少年已接近
A. 0.05
B. 0.08
C. 0.1
D. 0.15
E. 0.2

正确答案：B。0.08